抗菌谱和药理作用特点均类似于第三代头孢菌素的药物是
A. 头孢孟多
B. 头孢氨苄
C. 氨曲南
D. 拉氧头孢
E. 头孢吡肟

正确答案：D。拉氧头孢

解析：本题考查拉氧头孢。拉氧头孢（D对）为氧头孢烯类药，抗菌谱广，抗菌活性与第三代头孢菌素中的头孢噻肟相似。头孢孟多（A错）为第二代头孢菌素药。头孢氨苄（B错）为第一代头孢菌素类。氨曲南（C错）为单酰胺菌素类的代表药。头孢吡肟（E错）用于对其敏感的需氧革兰阴性菌中的肠杆菌，消化链球菌和丙酸杆菌所致的中重度感染。